研究脑梗死患者发生复发的相关因素，以发生脑梗死复发的患者作为病例组，适宜的对照应该是
A. 新发脑梗死患者
B. 病程与病例组相似，但未复发的脑梗死患者
C. 未发生过脑梗死的高血压患者
D. 患有心脑血管疾病以外的其他疾病的患者
E. 未发生过脑梗死的健康人

正确答案：B。病程与病例组相似，但未复发的脑梗死患者

解析：本题考查病例对照研究对照的选择。病例对照研究的对照必须是以与病例相同的诊断标准确认为不患所研究疾病的人（B对ACDE错）。另外，对照应该能够代表产生病例的源人群；换句话讲，对照的暴露分布应该与病例源人群的暴露分布一致。